固冲汤的功用是
A. 温补肝肾,固冲止血
B. 益气健脾,固冲摄血
C. 益气滋阴,化瘀止血
D. 降火坚阴,止血固经
E. 滋阴清热,止血固经

正确答案：B。益气健脾,固冲摄血

解析：固冲汤的功用是益气健脾,固冲摄血。主治脾肾亏虚，冲脉不固证，为治疗脾肾亏虚，冲脉不固之血崩、月经过多的常用方（B对）。